关于原发性肾小球疾病的光镜下病理特点，错误的是
A. 膜性肾病为不伴细胞增生的弥漫性肾小球毛细血管基底膜增厚
B. 微小病变病无明显异常，电镜下隐约可见上皮细胞肿胀足突广泛融合
C. 急进性肾炎是50%以上肾小球的肾小囊中有大新月体形成
D. 急性链球菌感染后肾小球肾炎是弥漫增生性肾小球炎症（内皮与系膜细胞增生）
E. 系膜增生性肾炎是系膜细胞及肾小球基底膜不同程度的弥漫增生

正确答案：E。系膜增生性肾炎是系膜细胞及肾小球基底膜不同程度的弥漫增生

解析：肾小球肾炎常见的有急性链球菌感染后肾小球肾炎、急进性肾炎、慢性肾小球肾炎，其光镜下病理特点分别为：①急性链球菌感染后肾小球肾炎是弥漫增生性肾小球炎症（内皮与系膜细胞增生）（D对）；②急进性肾炎是50%以上肾小球的肾小囊中有大新月体形成（C对）；③慢性肾小球肾炎病理类型较多，后期均可进展为程度不等的肾小球硬化，相应肾单位的肾小管萎缩、肾间质纤维化。引起原发性肾病综合征的肾小球疾病主要病理类型有微小病变型肾病、局灶节段性肾小球硬化、膜性肾病、系膜增生性肾小球肾炎及系膜毛细血管性肾小球肾炎。其光镜下病理特点分别为：①微小病变病无明显异常，电镜下隐约可见上皮细胞肿胀足突广泛融合（B对）；②局灶阶段性肾小球硬化光镜下可见病变呈局灶、节段分布，表现为受累节段的硬化（系膜基质增多、毛细血管闭塞、球囊粘连等），相应的肾小管萎缩、肾间质纤维化；③膜性肾病为不伴细胞增生的弥漫性肾小球毛细血管基底膜增厚（A对）；④系膜增生性肾炎是肾小球系膜细胞和系膜基质不同程度的弥漫增生（E错，为本题正确答案）；⑤系膜毛细血管性肾小球肾炎是系膜细胞和系膜基质弥漫重度增生。